一中年女性患者，自诉带下量多、色白、清稀，其病机多属
A. 肝郁脾虚
B. 肝肾亏虚
C. 寒湿下注
D. 脾肾阳虚
E. 湿热下注

正确答案：A、C、D。肝郁脾虚；寒湿下注；脾肾阳虚

解析：本题考查的是带下变化的临床意义。一中年女性患者，自诉带下量多、色白、清稀，其病机多属肝郁脾虚（A对）、寒湿下注（C对）与脾肾阳虚（D对）。带下变化的临床意义：正常情况下，妇女阴道内应有少量乳白色、无臭的分泌物，有濡润阴道壁的作用。若分泌过多或缠绵不绝，即为带下。其中色白、量多淋沥者，为白带；白带中混有血液、赤白分明的，为赤白带；带下淡红黏稠、似血非血，称为赤带；其色淡黄、黏稠臭秽，是为黄带。临床以白带、黄带较为多见。问带下，应注意了解量的多少，色质和气味等。若带下量多色白、清稀如涕，多属脾虚湿注；带下色黄、黏稠臭秽或伴有外阴瘙痒疼痛，多属湿热下注（E错）；带下色赤、淋沥不断、微有臭味，多属肝经郁热；带下晦暗、质稀薄而多、腰腹酸冷，多属肾虚（B错）。总之，凡带下色白而清稀的，多属虚证、寒证；色黄或赤，稠黏臭秽的，多为实证、热证。